梓醇是
A. 环烯萜类化合物
B. 倍半萜类化合物
C. 二萜类化合物
D. 二倍半萜类化合物
E. 三萜类化合物

正确答案：A。环烯萜类化合物

解析：本题考查的是含萜类化合物的成分。梓醇是环烯醚萜类化合物（A对）。按照分子中异戊二烯单位的数目可将萜类化合物分为单萜、倍半萜、二萜、二倍半萜、三萜、四萜及多萜。1.单萜：单萜类化合物有玫瑰油、香叶天竺葵油、柠檬草油和香茅油等中的香叶醇（牻牛儿醇）；薄荷中的薄荷醇；冰片中的龙脑等。2.环烯醚萜类：环烯醚萜类化合物有栀子中的栀子苷、京尼平苷、京尼平苷酸；鸡屎藤中的鸡屎藤苷；地黄中的梓醇、梓苷；龙胆中的龙胆苦苷；獐牙菜中的獐牙菜苷及獐牙菜苦苷等。3.倍半萜（B错）：如香茅草、橙花、玫瑰等中金合欢醇（法尼醇）；青蒿（黄花蒿）中的青蒿素；马桑毒素；羟基马桑毒素；莪术中的莪术醇等。4.二萜（C错）：如穿心莲内酯、芫花酯、雷公藤内酯、银杏内酯、紫杉醇等。二倍半萜类化合物（D错）多以海绵、植物病菌、昆虫代谢物的形式存在。三萜类化合物（E错）多以皂苷、树脂、植物乳汁的形式存在。